男，48岁。呕血5小时入院。查体：P120次/分，BP80/55mmHg。神智不清，营养状况差。巩膜明显黄染，腹壁可见静脉曲张，肝肋下可触及，质地较硬，边缘较钝，脾肋下6cm，移动性浊音阳性，肠鸣音弱。首选的检查是
A. 腹部X线片
B. 腹部B型超声
C. 上消化道钡餐造影
D. 腹腔动脉造影
E. 腹部CT

正确答案：B。腹部B型超声

解析：该患者查体可见巩膜黄染，腹壁静脉曲张，肝肋下可触及，质地较硬，边缘较钝，脾大，移动性浊音阳性提示有腹水，可初步诊断为肝硬化门脉高压症。腹部B型超声（B对）可显示腹水、肝密度及质地异常、门静脉扩张，可进一步明确诊断并找到出血原因。腹部X线片（A错）及腹部CT（E错）可观察肝、胆病变情况，但难以明确出血原因。急性出血期行上消化道钡餐造影（C错）有促使休克发生，或使已停止的出血再出血，因而不适宜进行。腹腔动脉造影（D错）用于估计有动脉性出血时明确出血部位。